关于结核菌素试验，下列哪项是正确的
A. 检出结核病
B. HIV感染后可强阳性，结核病越重越易呈强阳性
C. Ⅱ型变态反应
D. 检出结核分枝杆菌感染
E. 人体对外来物质的非特异性反应

正确答案：D。检出结核分枝杆菌感染

解析：结核菌素试验是一种基于Ⅳ型变态反应（C错）原理的一种皮肤试验，是人体对外来物质的特异性反应（E错），用来检测机体有无感染过结核杆菌（D对），而非检出结核病（A错），凡感染过结核杆菌的机体，在局部会产生红肿硬结的阳性反应，但在营养不良、HIV感染、严重的细菌感染等的结核菌素试验结果则多为阴性和弱阳性（B错）。